下列不属于行为危险因素监测的是
A. 吸烟
B. 酗酒
C. 不良饮食习惯
D. 安全套使用
E. 门诊患者就医情况

正确答案：E。门诊患者就医情况

解析：本题考查行为及危险因素监测。行为危险因素监测的内容包括：吸烟（A对）、酗酒（B对）、不良饮食习惯（C对）、安全套使用（D对）、酒驾、汽车安全带使用、安全头盔使用等。门诊患者就医情况（E错，为本题正确答案）属于症状监测的内容。